在配对病例对照研究的资料分析中，计算比值比公式中的分子的含义是
A. 病例暴露、对照非暴露于某因素的对子数
B. 病例和对照均暴露于某因素的对子数
C. 病例非暴露、对照暴露于某因素的对子数
D. 病例和对照均不暴露于某因素的对子数
E. 以上都不是

正确答案：A。病例暴露、对照非暴露于某因素的对子数

解析：本题考查比值比公式的含义。根据表5-3，配对病例对照研究中，OR＝c/b，分子c的含义为病例暴露、对照非暴露于某因素的对子数（A对BCDE错）。